苯妥英钠的消除速率与血药浓度有关。在低浓度（低于10㎍/ml）时，消除过程属于一级过程；高浓度时由于肝微粒体代谢酶能力有限，则按零级动力学消除，此时只要稍微增加剂量就可使血药浓度显著升高，易出现中毒症状。苯妥英钠在临床上的有效血药浓度范围是10～20㎍/ml。关于苯妥英钠药效学、药动学特征的说法，正确的是
A. 随着给药剂量增加，药物消除可能会明显减慢，会引起血药浓度明显增加
B. 苯妥英钠在临床上不属于治疗窗窄的药物，无需监测其血药浓度
C. 苯妥英钠的安全浓度范围较大，使用时较为安全
D. 指定苯妥英钠的安全浓度方案时，只需要根据半衰期制定给药间隔
E. 可以根据小剂量时的动力学参数预测高剂量的血药浓度

正确答案：A。随着给药剂量增加，药物消除可能会明显减慢，会引起血药浓度明显增加

解析：本题考查苯妥英钠药效学、药动学特征。苯妥英钠（A对）随着给药剂量增加，药物消除可能会明显减慢，会引起血药浓度明显增加。这是因为苯妥英钠具有“饱和代谢动力学”的特点，如果用量过大或短时内反复用药，可使代谢酶饱和，代谢将显著减慢，并易产生毒性反应。具非线性药动学特征的药物，在较大剂量时的表观消除速率常数比小剂量时的要小，因此不能根据小剂量时的动力学参数预测高剂量下的血药浓度（E错），一旦消除过程在高浓度下达到饱和，则血药浓度会急剧增大；当血药浓度下降到一定值时，药物消除速度与血药浓度成正比，表现为线性动力学特征。药物浓度太低不产生治疗效应，浓度太高则产生难以耐受的毒性，在这两个浓度之间限定一个合理治疗区域，该浓度区域常称为“治疗窗”（或称为治疗范围）。苯妥英钠在临床上的有效血药浓度范围是10～20㎍/ml，安全浓度范围较小，属于治疗窗窄的药物（C错），在临床上需要经常监测血药浓度（B错），儿童患者使用此类药物时需要频繁的调整剂量并要按照体重计算药量（D错）。